患者，女，28岁，近一个月出现阴道分泌物增多，痛痒明显，阴道检查时发现黏稠的奶酪样分泌物，经验治疗首选的药物是
A. 甲硝唑
B. 咪康唑
C. 头孢曲松钠
D. 青霉素钠
E. 克拉霉素

正确答案：B。咪康唑

解析：本题考查阴道炎治疗药。真菌性阴道炎的主要表现是白带量多并有臭味，黏稠呈奶酪样或豆腐渣样或白色片状，采用抗真菌药，如咪康唑、克霉唑、益康唑、联苯苄唑、制霉菌素等的栓剂或阴道片剂给药，首选硝酸咪康唑栓（B对），严重者口服给药。甲硝唑（A错）用于治疗滴虫性阴道炎。头孢曲松钠（C错）用于盆腔炎性疾病的治疗。克拉霉素（E错）是红霉素的衍生物，可用于沙眼衣原体或溶脲脲原体所致生殖泌尿系感染。